膝关节是人体内最大最复杂的关节，肌主要配布于前后方向，其主要运动为屈和伸，在特定体位（半屈膝时）可作旋内和旋外的运动。伸膝关节的肌是
A. 缝匠肌
B. 股四头肌
C. 阔筋膜张肌
D. 大收肌
E. 股二头肌

正确答案：B。股四头肌

解析：股四头肌（B对）可以屈髋关节和伸膝关节。缝匠肌（A错）可以屈髋关节，屈膝关节。阔筋膜张肌（C错）可以紧张阔筋膜，屈髋关节，大收肌（D错）可以使髋关节内收、旋内， 股二头肌（E错）可以屈膝、伸髋，使已屈的膝关节旋外。